患者男性56岁，左右上345颊侧颈部楔状缺损，中等深度，探诊较敏感。患者因有事，要求一次完成治疗。最好选用下列哪种材料治疗
A. 银汞合金
B. 氧化锌丁香油糊剂
C. 玻璃离子水门汀
D. 复合树脂
E. 磷酸锌水门汀

正确答案：C。玻璃离子水门汀

解析：本题考查玻璃离子水门汀。患者男性56岁，左右上345颊侧颈部楔状缺损，中等深度，探诊较敏感。患者因有事，要求一次完成治疗。最好选用玻璃离子水门汀（C对）。患者左右上345颊侧颈部楔状缺损，患牙位置靠前，应考虑充填材料的美观性；缺损中等深度，探诊较敏感，一次充填需选用刺激性小的充填材料。玻璃离子可作为中等深度窝洞的垫底材料，其对牙髓的刺激性较小，美观性尚可，其作为充填材料也具有一定的强度。银汞合金美观性欠佳，且为良导体，充填时应先垫底，不能用于直接充填（A错）。氧化锌丁香油糊剂一般用于垫底、安抚和暂封，一般不用于永久充填（B错）。复合树脂美观性和强度都较玻璃离子更佳，但复合树脂对牙髓刺激作用明显，需要垫底，不能用于中等深度窝洞的直接充填（D错）。磷酸锌水门汀可释出游离酸，对牙髓有明显的刺激作用，且磷酸锌水门汀一般不用作永久充填（E错）。